下列五种感染过程中最常见的是
A. 病原体被清除
B. 隐性感染
C. 显性感染
D. 病原携带状态
E. 潜伏性感染

正确答案：B。隐性感染

解析：病原体被清除（A错）、隐性感染、显性感染（C错）、病原携带状态（D错）、潜伏性感染（E错）都是传染病感染过程的表现形式，其中隐性感染（B对）最常见，显性感染（C错）最少见。